关于穿刺检查的内容下列叙述不正确的是
A. 脓肿穿刺多选用8号或9号粗针
B. 临床上如怀疑是颈动脉体瘤或动脉瘤，可以进行穿刺检查
C. 怀疑是结核性病变时，进针时要注意避免因穿刺形成经久不愈的窦道
D. 对唾液腺肿瘤和某些深部肿瘤用6号针头行穿刺细胞学检查
E. 血管性病变选用7号针

正确答案：B。临床上如怀疑是颈动脉体瘤或动脉瘤，可以进行穿刺检查

解析：本题考查口外一般检查及辅助检查。穿刺应在严格消毒的条件下进行，选用适宜的针头。临床上脓肿穿刺多选用8号或9号粗针（A对），血管性病变选用7号针（E对）。对唾液腺肿瘤和某些深部肿瘤用6号针头行穿刺细胞学检查（D对），或称“细针吸取活检”，而粗针吸取活检，除非特殊需要，多不提倡，以免造成瘤细胞种植。此外，穿刺检查还应掌握正确的操作方法，要注意进针的深度和方向，以免损伤重要的组织结构。临床上如怀疑是颈动脉体瘤或动脉瘤，则禁忌穿刺（B错，为本题正确答案）。怀疑是结核性病变时，进针时要注意避免因穿刺形成经久不愈的窦道（C对）。